可诱导肝药酶活性的抗结核病药是
A. 异烟肼
B. 利福平
C. 吡嗪酰胺
D. 对氨基水杨酸
E. 链霉素

正确答案：B。利福平

解析：本题考查酶的诱导与抑制。可诱导肝药酶活性的抗结核病药是利福平（B对）；异烟肼（A错）为肝药酶抑制剂；吡嗪酰胺（C错）是类似于异烟肼的烟酸衍生物,但与异烟肼之间无交叉耐药性；对氨基水杨酸（D错）对结核分枝杆菌有抑制作用,为二线的抗结核药；链霉素（E错）是氨基糖苷类抗生素,具有较强的抗结核菌的作用。